男，25岁，车祸后四肢麻木无力2天。查体：神志清楚，四肢肌力3级，肌张力增高。颈4以下的深浅感觉减退。最可能损伤的部位是
A. 颈膨大以下颈髓
B. 脑实质
C. 胸髓
D. 腰骶膨大
E. 颈膨大及以上颈髓

正确答案：E。颈膨大及以上颈髓

解析：高颈髓（C1～4）损害平面以下各种感觉缺失，四肢呈上运动神经元瘫痪（E对）；颈膨大损害两上肢呈下运动神经元瘫痪，两下肢呈上运动神经元瘫痪；胸髓损害，双下肢呈上运动神经元瘫痪，括约肌障碍，受损节段常伴有束带感（AC错）。